与血的生成不直接相关的是
A. 营气
B. 津液
C. 肾所藏的精
D. 水谷精微之气
E. 自然清阳之气

正确答案：E。自然清阳之气

解析：本题考查的是血的生成。与血的生成不直接相关的是从自然清阳之气（E错，为本题正确答案）。血的生成：水谷精微（D对）和肾精（C对）是血液化生的基础物质。中焦脾胃受纳运化饮食水谷，吸收水谷之精微，水谷之精微化生营气和津液，二者进入脉中，经过心肺的气化作用，变化而成红色的血液。由水谷之精化生的营气（A对）和津液（B对）是化生血液的主要物质，也是血液的主要组成部分。由于营气和津液都来源于水谷精气，故饮食物的优劣和脾胃运化功能的强弱，直接影响着血液的化生。另一途径，肾精化血。精和血之间，还存在着相互资生和相互转化的关系。精藏于肾，血藏于肝，肾中精气充盈，则肝有所养，血有所充，肝藏血充足，则肾有所藏，精有所生，故有“精血同源”之说。肾藏精，精生髓，髓化血。肾精充足，则化为血液，充养全身。自然清阳之气为气的来源之一。气的生成：气来源于父母先天之精气、后天饮食物中的水谷精微以及从自然界吸入的清气。